创古本草增收新药数目之冠的本草著作是
A. 新修本草
B. 神农本草经
C. 本草经集注
D. 本草纲目拾遗
E. 经史证类备急本草

正确答案：D。本草纲目拾遗

解析：本题考查历代本草代表作。创古本草增收新药数目之冠的本草著作是《本草纲目拾遗（D对）》。《本草纲目拾遗》：简称《纲目拾遗》，为清代本草代表作。作者赵学敏在广泛收集民间用药和注意研究外来药的基础上撰成此书。全书共10卷，载药921种，其中新增716种，创古本草增收新药之冠，极大地丰富了本草学。同时，对《本草纲目》略而不详的加以补充，错误的加以订正，不但总结了16～18世纪本草学发展的新成就，而且还保存了大量今已散佚的方药书籍的部分内容，具有很高的实用价值和文献价值。《新修本草（A错）》：又称《唐本草》，为隋唐时期唐代的本草代表作。该书是在普查全国药材基础上，由长孙无忌、李勣、苏敬等22人共同编撰而成。本书的完成依靠了国家的行政力量和充足的人力物力，是我国历史上第一部官修药典性本草，并被今人誉为世界上第一部药典，比公元1546年问世的欧洲纽伦堡药典《科德药方书》早887年。该书无论在内容和编写形式上都有新的突破，全面总结了唐以前的药物学成就，并很快流传于海内外，对后世医药学的发展影响极大。《神农本草经》（B错）：简称《本经》，为汉代本草代表作。该书虽假托传说中的神农而作，但并非出于一时一人之手，而是经历了较长时间的补充和完善。该书系统总结了汉代以前我国药学发展的成就，是现存最早的药学专著，为本草学的发展奠定了基础。《本草经集注（C错）》：为魏晋南北朝本草代表作。作者为陶弘景，书成于公元500年左右（南北朝梁代）。该书第一次全面系统地整理、补充了《本经》，反映了魏晋南北朝时期的本草学成就，初步确立了综合性本草著作的编写模式。《经史证类备急本草（E错）》：简称《证类本草》，为宋金元时期宋代的本草代表作。作者唐慎微，以掌禹锡的《嘉祐本草》和苏颂的《图经本草》为基础，并收集转录了大量宋以前各代名医对本草的真知灼见、经史传记和佛书道藏中有关本草的论述，以及民间防治疾病的经验和单方，撰成此书。该书图文对照，方药并收，医药结合，资料翔实，集宋以前本草之大成，使大量古代文献得以保存，具有极高的学术价值和文献价值。